罗非昔布（万络）撤出市场是因为药物流行病学定群研究发现其有严重的
A. 损害肝功能的不良事件
B. 损害肾功能的不良事件
C. 损害心血管的不良事件
D. 损害骨骼肌的不良事件
E. 损害脑神经的不良事件

正确答案：C。损害心血管的不良事件

解析：本题考查药品上市后风险评估。2003年罗非昔布上市后风险评估发现大剂量服用者，患心肌梗死和心脏猝死的危险增加3倍，属于心血管的不良事件（C对）。灰婴综合征（A错）属于损害肝功能的不良事件。马兜铃酸（B错）事件属于损害肾功能的不良事件。他汀类中毒（D错）属于损害骨骼肌的不良事件。氯丙嗪中毒（E错）属于损害脑神经的不良事件。